淀粉可作为
A. 崩解剂
B. 黏合剂
C. 两者均可
D. 两者均不可

正确答案：C。两者均可

解析：本题考查片剂的常用辅料。淀粉可用作片剂的稀释剂、黏合剂、崩解剂（C对），黏合剂用量在5%～25%，崩解剂用量在3%～15%。